下列呕吐物呈咖啡色的疾病是
A. 幽门梗阻
B. 上消化道出血
C. 溃疡性结肠炎
D. 食物中毒
E. 空肠梗阻

正确答案：B。上消化道出血

解析：上消化道出血（B对）是指屈氏韧带以上的消化道，包括食管、胃、十二指肠或胰胆等病变引起的出血，其临床主要表现为呕血和（或）黑粪，幽门以上的出血则呕血与黑便并见，出血量少时，血红蛋白经酸作用后变成酸化正铁血红蛋白，呕吐物为咖啡色或棕褐色往往伴有血容量减少引起的急性周围循环衰竭，是常见的急症。幽门梗阻（A错）的呕吐物常为宿食。溃疡性结肠炎（C错）是一种病因尚不十分清楚的结肠和直肠慢性非特异性炎症性疾病，病变局限于大肠黏膜及黏膜下层，血性腹泻是最常见的早期症状。其他症状依次有腹痛、便血、体重减轻、里急后重、呕吐等。食物中毒（D错）引起的呕吐物常为该食物。空肠梗阻（E错）引起的呕吐物含有胆汁。